下列哪一条不是原发性醛固酮增多症的特点
A. 高血压为最早出现的症状
B. 尿钾排出减低，通常24小时尿钾﹤25mmol/L
C. 可以有低钾性碱中毒
D. 可以有心电图异常
E. 肾小管上皮细胞空泡变性，浓缩功能减退

正确答案：B。尿钾排出减低，通常24小时尿钾﹤25mmol/L